关于宫颈原位癌的描述正确的是
A. 宫颈上皮内瘤变即为宫颈原位癌
B. 异型细胞侵犯宫颈间质血管和淋巴
C. 异型细胞累及上皮全层，未穿透基底膜
D. 异型细胞侵犯宫颈腺体，穿透基底膜
E. 异型细胞侵犯上皮的1/3～2/3

正确答案：C。异型细胞累及上皮全层，未穿透基底膜

解析：宫颈原位癌是指异型细胞累及上皮全层，未穿透基底膜（C对）的宫颈癌。异型细胞侵犯宫颈腺体，未穿透基底膜（D错）称为原位癌累及腺体，也属于宫颈原位癌。子宫颈上皮异型增生属癌前病变，可分为Ⅰ、Ⅱ、Ⅲ级，其中异型细胞侵犯上皮的1/3-2/3（E错）为子宫颈上皮异型增生Ⅱ级。宫颈上皮内瘤变（CIN）不同于宫颈原位癌，前者可分为Ⅰ、Ⅱ、Ⅲ型，其中CINⅢ包括Ⅲ级异型增生和原位癌（A错）。异型细胞侵犯宫颈间质血管和淋巴（B错）是宫颈浸润癌的表现。